患者，男，40岁。小便频急，茎中热痛，刺痒不适，尿色黄浊，尿末或大便时有白浊滴出，会阴、腰骶、睾丸有明显的胀痛不适，舌红苔黄根腻，脉弦滑。诊为慢性前列腺炎，其证候是
A. 肾阳不足
B. 肝肾不足
C. 阴虚火动
D. 湿热壅阻
E. 气滞血瘀

正确答案：D。湿热壅阻

解析：患者体内湿热下注阴部可见小便频急，茎中热痛，刺痒不适，湿性黏腻，尿色黄浊，尿末或大便时有白浊滴出，湿热长期不清，则精道气血淤滞，故见阴、腰骶、睾丸有明显的胀痛不适，舌红苔黄根腻，脉弦滑亦符合湿热壅阻（D对）。肾阳不足可见排尿淋漓，腰膝酸痛，阳痿早泄，形寒肢冷，舌淡胖，苔白，脉沉细（A错）。肝肾不足见头晕、目干涩、腰膝酸软等（B错）。阴虚火动伴见遗精或血精，腰膝酸软；五心烦热，失眠多梦；舌红少苔，脉细数（C错）。气滞血瘀多见于病程较长的患者，舌暗或有瘀斑，苔白或薄黄，脉沉涩（E错）。